长期大剂量服用黄药子引起中毒的机理是
A. 使心脏停止于收缩期
B. 毒性成分可透过血脑屏障，产生中毒症状
C. 损害肝细胞而发生黄疸
D. 抑制呼吸中枢及周围神经系统
E. 兴奋中枢神经系统及血管运动中枢

正确答案：C。损害肝细胞而发生黄疸

解析：本题考查的是中药饮片的不良反应。长期大剂量服用黄药子引起中毒的机理是损害肝细胞而发生黄疸（C对）。黄药子的不良反应表现：目前临床报道的与黄药子及其制剂相关的安全性问题主要是肝毒性，且有死亡病例发生。其肝损害的临床表现，以混合性损伤为主，兼有肝细胞损伤和胆汁淤积的症状，且损伤程度和剂量与给药时间有关。实验室检查血ALT、AST、STB等显著升高。一般常见症状为乏力、纳差、尿黄、头晕、厌油腻，有的伴有巩膜、皮肤黄染，瘙痒，大便灰白等，严重者表现为急性肝炎等，有的患者伴有胆囊炎。大剂量服用可引起恶心、呕吐、脱发等症状。文献报道黄药子亦可引起肾损害和甲状腺损害，临床应用过程中应注意加强监测。可能的机制：研究提示其毒性与薯蓣皂苷、薯蓣毒皂苷、二萜内酯类成分如黄独乙素、黄酮类和皂苷类等有关。使心脏停止于收缩期（A错）为蟾酥及含蟾酥的中成药的中毒机制。蟾酥及含蟾酥的中成药的中毒机制：主要毒性成分是强心苷（蟾酥毒素），还含有儿茶酚胺类化合物、肾上腺素、去甲肾上腺素等。蟾蜍毒素有洋地黄样作用，小剂量能使心肌收缩力增强，大剂量则使心脏停止于收缩期。毒性成分可透过血脑屏障，产生中毒症状（B错）为含朱砂、轻粉、红粉的中成药的中毒机制。含朱砂、轻粉、红粉的中成药的中毒机制：此类药物含汞，属汞中毒。机体吸收后迅速弥散到各个器官和组织，并可通过血-脑屏障进入脑组织，产生各种中毒症状。抑制呼吸中枢及周围神经系统（D错）为罂粟壳的中毒机制。罂粟壳的不良反应表现：罂粟壳中含有的主要成分是吗啡、可待因、罂粟碱等，罂粟壳中毒与其所含的主要成分吗啡有关。其临床表现为昏睡或昏迷，抽搐，呼吸浅表而不规则，恶心、呕吐、腹泻，面色苍白，发绀、瞳孔极度缩小呈针尖样，血压下降等。目前文献报道的病例报告中，罂粟碱中毒均体现在婴幼儿中，可能因为婴儿中枢神经系统、肝、肾、酶系统等发育未成熟，对中药较敏感，易引起中毒。可能的机制：吗啡对大脑皮质感觉区、延髓呼吸及咳嗽中枢均有抑制作用，严重者可因呼吸抑制而死亡。少数合并抽搐，抽搐可能与呼吸抑制引起脑细胞缺氧、水肿有关。兴奋中枢神经系统及血管运动中枢（E错）为马钱子及含马钱子的中成药的中毒机制。马钱子及含马钱子的中成药的中毒机制：马钱子含番木鳖碱即士的宁，毒性大。成人服用5～10mg即可中毒，一次服用30mg即可致死。番木鳖碱首先兴奋中枢神经系统，引起脊髓强直性痉挛，继而兴奋呼吸中枢及血管运动中枢。